苯海索的药理作用是
A. 激动中枢阿片受体
B. 抑制中枢神经系统胆碱酯酶
C. 抑制纹状体单胺氧化酶
D. 阻断中枢神经系统胆碱受体
E. 激动黑质纹状体通路多巴胺受体

正确答案：D。阻断中枢神经系统胆碱受体

解析：本题考查苯海索的药理作用。苯海索通过抑制黑质-纹状体通路ACh的作用（D对），以恢复纹状体多巴胺能神经与胆碱能神经之间的平衡。对震颤效果好，但对运动迟缓效果差。主要用于抗精神病药阻断DA受体引起的锥体外系反应（迟发运动障碍除外）及以震颤为主的PD等，而对无震颤的PD患者不推荐应用。